直接作用于中枢神经系统，使之兴奋或抑制，连续使用后能产生身体依赖性的药品是
A. 精神药品
B. 一类精神药品
C. 二类精神药品
D. 麻醉药品
E. 戒毒药品

正确答案：A。精神药品

解析：本题考查精神药品。直接作用于中枢神经系统，使之兴奋或抑制，连续使用后能产生身体依赖性的药品是精神药品（A对）。麻醉药品（D错）是指连续使用后易产生身体依赖性、能成瘾癖的药品。